男性患者，17岁，近来饮冷水时，有左上后牙一过性疼痛。检查发现：左上第一磨牙近中邻面有深龋洞，在治疗这个龋的过程中，最易出现意外穿髓的部位是
A. 近中颊侧髓角和远中颊侧髓角
B. 近中舌侧髓角和远中舌侧髓角
C. 近中颊侧髓角和近中舌侧髓角
D. 远中颊侧髓角和远中舌侧髓角
E. 以上都不是

正确答案：C。近中颊侧髓角和近中舌侧髓角

解析：本题考查恒磨牙髓腔形态及乳恒牙髓腔临床意义。髓角为髓腔顶突向牙尖的部位，其形态与相应牙尖形态一致，根据牙尖形态高低不同，髓角的突起高低不同。上颌第一磨牙中，颊侧牙尖高于舌侧牙尖，近中牙尖高于远中牙尖，因此，髓角由高向低依次为近中颊侧髓角、近中舌侧髓角（C对）、远中颊侧髓角和远中舌侧髓角。